有关菌群失调说法错误的是
A. 各菌种之间的比例发生较小幅度的变化
B. 引起菌群失调症
C. 由滥用广谱抗生素引起
D. 寄生在正常人体某部位的正常菌群
E. 菌种比例发生了超出正常范围的改变

正确答案：A。各菌种之间的比例发生较小幅度的变化

解析：菌群失调指寄生在正常人体某部位的正常菌群，各菌种之间的比例发生了较大幅度的超出正常范围的改变，多由滥用广谱抗生素引起。由于菌群失调引起的疾病，称为菌群失调症。掌握“细菌的分类”知识点。